下列属于选择性5-羟色胺再摄取抑制剂的是
A. 吗氯贝胺
B. 氯米帕明
C. 米安色林
D. 马普替林
E. 帕罗西汀

正确答案：E。帕罗西汀

解析：属于选择性5-羟色胺再摄取抑制剂的是氟西汀、帕罗西汀（E对）、舍曲林、氟伏沙明、西酞普兰和艾司西酞普兰。吗氯贝胺（A错）是单胺氧化酶抑制剂。氯米帕明（B错）、马普替林（D错）是三环类抗抑郁药。米安色林（C错）是α2肾上腺素受体阻滞剂。